眼球壁的中膜最肥厚的部分是
A. 脉络膜前部
B. 脉络膜后部
C. 虹膜
D. 睫状体
E. 内侧部为骨性部

正确答案：D。睫状体

解析：眼球壁的中膜最肥厚的部分是睫状体（D对）。